胆固醇不能转化成
A. 胆汁酸
B. 维生素D₃
C. 睾酮
D. 雌二醇
E. 胆红素

正确答案：E。胆红素